服药时应限制饮水的药品是
A. 熊去氧胆酸
B. 苯溴马隆
C. 口服补液盐
D. 阿仑膦酸钠
E. 硫糖铝

正确答案：E。硫糖铝

解析：本题考查服用药品的特殊提示。硫糖铝（E对）是胃黏膜保护剂，服用后在胃中形成保护膜，服药后1小时内尽量不要喝水，防止保护膜被水冲掉。熊去氧胆酸（A错）、苯溴马隆（B错）和阿仑膦酸钠（D错）服用后宜多饮水。口服补液盐（C错）是粉状，服用前用500～1000ml凉开水溶解。